女性，24岁，发作性干咳3月，无发热、咯血、胸痛、胸闷，多次拍胸片未发现异常，反复用过“阿莫西林、阿奇霉素及止咳药”未见效，去年本季节（春天）曾有同样症状发作，曾服用过“氨茶碱”后完全缓解。查体：T37.2℃，P100次/分，R18次/分，BP120/75mmHg，双肺未闻及哮鸣音及湿啰音。为明确诊断首选的检查是
A. 血常规
B. 心电图
C. 支气管激发试验
D. 胸部X线片
E. 结核菌素试验

正确答案：C。支气管激发试验

解析：青年女性患者，发作性干咳3月，无发热、咯血、胸痛、胸闷，多次拍胸片未发现异常，反复用过“阿莫西林、阿奇霉素及止咳药”未见效（可排除肺部感染），去年本季节（春天）曾有同样症状发作，曾服用过“氨茶碱”后完全缓解（提示支气管哮喘），查体：T37.2℃（正常值为36.5℃～37.2℃），P100次/分（正常值为60～100次/分），R18次/分（正常值为16～20次/分），BP120/75mmHg（正常值为90～140/60～90mmHg），双肺未闻及哮鸣音及湿啰音，根据该患者的病史、临床症状及体征，考虑最可能的诊断为支气管哮喘中的咳嗽变异性哮喘，为明确诊断首选的检查是支气管激发试验（C对），该试验阳性提示气流受限，有助于哮喘的诊断。心电图（A错）、血常规（B错）属于住院的常规检查，对哮喘的诊断并无帮助。胸部X线片（D错）哮喘发作时胸部X线可见两肺透亮度增加，呈过度通气状态，缓解期多无明显异常。结核菌素试验（E错）主要用于结核病的诊断。